长期大量服用可引起肝脏肿大，肾脏损害的维生素是
A. 维生素A
B. 维生素B₁
C. 维生素C
D. 维生素D
E. 维生素E

正确答案：D。维生素D

解析：本题考查维生素D的不良反应。长期大量服用维生素D（D对）可引起肝脏肿大，肾脏损害。长期大量服用维生素A（A错）早期会出现食欲减退；之后出现皮肤干燥，偶有发生血钙增高。维生素B₁（B错）易通过肾脏排出，未有因长期大量摄入发生不良事件。大量服用维生素C（C错）可引起腹泻、皮疹。每日用量超过5g时，可导致溶血，重者可致命。长期服用大剂量维生素E（E错）会出现血栓性静脉炎或肺栓塞，糖尿病或心绞痛症状明显加重，激素代谢紊乱，凝血酶原降低。以上长期大量服用均不会引起肾脏损害。